女性，32岁，不慎被机器将长发辫卷入造成大块头皮撕脱。关于其创面的描述不正确的是
A. 出血较多，疼痛剧烈，易发生休克
B. 创缘整齐，有明显的出血点
C. 皮下组织及肌肉均有挫伤
D. 颅骨暴露
E. 部分耳廓、眉毛连同上眼睑同时撕脱

正确答案：B。创缘整齐，有明显的出血点

解析：本题考查头皮撕脱伤。创缘整齐，有明显的出血点（B错，为本题的正确答案）可见于因锐器所致的头皮裂伤。女性，32岁，不慎被机器将长发辫卷入造成大块头皮撕脱，应诊断为头皮撕脱伤。头皮撕脱伤是最严重的头皮损伤，几乎均因发辫卷人转动的机器所致；由于皮肤、皮下组织和帽状腱膜三层紧密连接，所以在强烈的牵扯下，往往将头皮自帽状腱膜下间隙全层撕脱，有时还连同部分骨膜，造成颅骨暴露（D对）。撕脱范围与受到牵扯的头发面积相关，严重者整个头皮甚至连前部的额肌一起撕脱，可部分耳廓、眉毛连同上眼睑同时撕脱（E对），皮下组织及肌肉均有挫伤（C对）。伤后出血较多，疼痛剧烈，易发生休克（A对），应及时处理。